下列疾患可造成舌乳头萎缩，除了
A. 扁平苔藓
B. 干燥综合征
C. 盘状红斑狼疮
D. B族维生素缺乏
E. 口腔念珠菌感染

正确答案：C。盘状红斑狼疮

解析：本题考查可造成舌乳头萎缩的口腔黏膜病。盘状红斑狼疮（C错，为本题的正确答案）不会造成舌乳头萎缩。可造成舌乳头萎缩的疾病有：扁平苔藓（A对），舌背丝状及菌状乳头萎缩，上皮变薄，红亮光滑，常伴有糜烂；干燥综合征（B对）又叫舍格伦综合征，舌背丝状乳头萎缩，舌表面光滑潮红呈镜面舌；B族维生素缺乏症（D对），病程长者表现为萎缩性舌炎，舌乳头萎缩，舌面光滑，呈亮红色；口腔念珠菌感染（E对），严重时舌背黏膜呈鲜红色并有舌乳头萎缩。